脾胃虚弱、食少便溏、气短咳嗽、肢倦乏力，宜选用的中成药是
A. 麦味地黄丸
B. 人参归脾丸
C. 参苓白术散
D. 香砂六君丸
E. 七宝美髯丸

正确答案：C。参苓白术散

解析：本题考查的是参苓白术散的主治。脾胃虚弱、食少便溏、气短咳嗽、肢倦乏力，宜选用的中成药是参苓白术散（C对）。参苓白术散：【主治】脾胃虚弱，食少便溏，气短咳嗽，肢倦乏力。麦味地黄丸（A错）：【主治】肺肾阴亏，潮热盗汗，咽干咳血，眩晕耳鸣，腰膝酸软，消渴。人参归脾丸（B错）：【主治】心脾两虚、气血不足所致的心悸、怔忡、失眠健忘、食少体倦、面色萎黄，以及脾不统血所致的便血、崩漏、带下。香砂六君丸（D错）：【主治】脾虚气滞，消化不良，嗳气食少，脘腹胀满，大便溏泄。七宝美髯丸（E错）：【主治】肝肾不足所致的须发早白、遗精早泄、头眩耳鸣、腰酸背痛。